患儿，6岁。发热2天，伴咽痛，皮疹1日，体检：体温38.7℃，咽部充血，草莓舌。面部潮红，躯干部见细小鲜红色充血性皮疹，诊断为猩红热，治疗首选
A. 红霉素
B. 头孢唑啉
C. 氯霉素
D. 青霉素
E. 磷霉素

正确答案：D。青霉素

解析：学龄前儿童，已诊断为猩红热，治疗应首选青霉素（D对），该病主要是由于感染乙型溶血型链球菌所致，青霉素能够迅速消灭链球菌。红霉素（A错）、头孢唑啉（B错）、氯霉素（C错）、磷霉素（E错）治疗该病的疗效不佳。